不属于突发公共卫生事件的主要特征的是
A. 突发公共卫生事件的发生一般是难以预测的
B. 地点分布各异
C. 时间分布各异
D. 有后期效应
E. 具有绝对性

正确答案：E。具有绝对性

解析：本题考查突发公共卫生事件的特征。突发公共卫生事件的特征有：1.突发性：突发公共卫生事件的发生一般是难以预测的（A对），而且地点（B对）、时间（C对）分布各异；2.准备和预防的困难性；3.表现呈多样性；4.处置和结局的复杂性；5.群体性；6.后果的严重性：具有后期效应（D对）。具有绝对性（E错，为本题正确答案）不是突发公共卫生事件的特征。